患者，男性，53岁，2型糖尿病，控制饮食无效，体重超重，过度肥胖，选下列哪种降糖药为最佳
A. 格列齐特
B. 格列苯脲
C. 甲苯磺丁脲
D. 格列吡嗪
E. 二甲双胍

正确答案：E。二甲双胍